男性，16岁。发热10天伴食欲减退，体弱。体检：体温39.6℃，脉搏74次/分，肝肋下2.0cm，脾肋下1.0cm。外周血白细胞2.6×10⁹/L，中性粒细胞0.85，淋巴细胞0.14，嗜酸粒细胞0.01，临床上拟诊断伤寒，为确定诊断选用下列哪一种培养最恰当
A. 粪便培养
B. 血培养
C. 尿培养
D. 胆汁培养
E. 玫瑰疹刮取物培养

正确答案：B。血培养

解析：本例患者拟诊断伤寒，属于肠热症，根据病史知已发病10天（＜2周），为确定诊断选用血培养（B对）最恰当，其结果更可靠。肠热症随病程的进展，细菌出现的主要部位不同，因而根据不同的病程采取不同标本，第1、2周取外周血，2周后取粪便（A错），第3周起还可取尿液（C错），从第1周至第3周均可去骨髓液。胆汁培养（D错）对于确定伤寒带菌者有极大价值。约半数以上的伤寒患者会出现玫瑰疹，玫瑰疹刮取物培养（E错）在必要时亦可进行。